下列哪一点不属于瘀血致病的临床表现
A. 唇甲色淡
B. 肌肤甲错
C. 刺痛拒按
D. 出血、紫绀
E. 肿块固定

正确答案：A。唇甲色淡

解析：血液亏虚，不能濡养头目、筋脉、肌肤，故唇甲色淡，不属于瘀血的致病表现（A错，为本题正确答案）。瘀血致病的临床表现：a.疼痛：一般表现为刺痛，痛处固定不移，拒按，夜间痛势尤甚（C对）。b.肿块：淤血积于皮下或体内，则可见肿块，部位固定不移。若在体表，则可见局部青紫，肿胀隆起；若在体内，则们之质硬，坚固难移（E对）。c.出血：部分淤血为病者，可见出血之象，血色紫暗，夹有瘀块(D对)。血行障碍，气血不能濡养肌肤，则见肌肤甲错（B对）。